男，18岁。因终末肾脏病行肾脏移植手术，其母亲为其供肾者，这种移植类型是
A. 同基因移植
B. 同种异体移植
C. 异种移植
D. 同系移植
E. 自体移植

正确答案：B。同种异体移植

解析：患者行肾移植手术以其母亲的肾脏作为供体，其母亲与患者属于同种但不同基因型属于同种异体移植（B对）；自体移植（E错）指移植物完全取自患者自身；同基因移植（A错）或供体与受体基因基本相似统称同系移植（D错），供体基因与受体基因大致相同；异种移植（C错）指不同种属个体之间的移植（P184）。